下列对心衰原因的叙述哪一项是不正确的
A. 心肌严重缺血缺氧
B. 压力负荷过重，导致心脏过度紧张源性扩张
C. 心肌结构破坏
D. 严重贫血可因长期前负荷过重而心衰
E. 心脏容量负荷或压力负荷过重

正确答案：B。压力负荷过重，导致心脏过度紧张源性扩张

解析：心衰的病因可分为心肌收缩性降低、心室负荷过重、心室舒张及充盈受限。心肌严重缺血缺氧（A错）引起心肌能量代谢障碍，可合并结构异常，导致心肌收缩性降低。而心肌结构破坏（C错）同样可引起心肌收缩性降低。当心脏容量负荷或压力负荷过重（E错）例如严重贫血使心脏前负荷长期过重（D错）以致于心室重塑不能代偿时，心脏舒缩功能降低。容量负荷过重（B对）可使舒张末期容积过高，心室过度扩张反而使心肌细胞有效横桥数目减少，心肌收缩力降低，这种过度紧张源性扩张称为肌源性扩张。